某一急性药物中毒病人，表现为昏迷、瞳孔极度缩小，呼吸深度抑制，血压降低，出现上述中毒症状的药物，是
A. 苯巴比妥
B. 吗啡
C. 地西泮
D. 氯丙嗪
E. 苯妥英钠

正确答案：B。吗啡

解析：急性药物中毒患者表现为昏迷、呼吸抑制和瞳孔缩小即阿片类药物中毒“三联征”典型表现并出现了血压降低，考虑患者出现了吗啡（B对）中毒。吗啡可直接抑制呼吸调节中枢产生呼吸抑制作用、作用于中脑顶盖前核阿片受体引起瞳孔缩小、扩张容量血管及阻力血管引起血压下降。苯巴比妥中毒（A错）表现为中枢神经系统抑制症状，轻度中毒时表现为嗜睡、情绪不稳定、注意力不集中、记忆力减退、共济失调、发音含糊不清、步态不稳和眼球震颤；重度中毒时，进行性中枢神经系统抑制，由嗜睡到深昏迷，可出现低血压或休克、肌张力下降、腱反射消失、大疱样皮损等表现（P903），一般不会出现瞳孔缩小。急性地西泮（C错）中毒表现为神经系统抑制症状，如嗜睡、头晕等，很少出现深度昏迷和呼吸抑制（P903），亦无瞳孔缩小表现。急性氯丙嗪（D错）中毒常出现锥体外系反应，临床表现有以下三类：①震颤麻痹综合征；②静坐不能；③急性肌张力障碍反应，不会出现昏迷、呼吸抑制及瞳孔缩小。急性苯妥英钠中毒（E错）常出现神经系统反应如眼球震颤、复视、眩晕等。